测定肺换气效率较好指标是
A. 潮气量
B. 肺活量
C. 时间肺活量
D. 通气/血流比值
E. 肺扩散容量

正确答案：D。通气/血流比值